地区分布
A. 森林脑炎见于春天
B. 吸毒、不正当性行为可致艾滋病
C. 城市肺癌发病率和死亡率高于农村
D. 流行性乙型脑炎和脊髓灰质炎多有隐性流行
E. 霍乱可发生大流行

正确答案：C。城市肺癌发病率和死亡率高于农村

解析：本题考查地区分布的特征。疾病的地区分布可采用行政区划法，行政区划法简便易行，在一个国家可按省、市、县、乡等行政区域来划分。划分的城市与农村肺癌发病率和死亡率的差别（C对ABDE错）为地区分布导致的疾病差异。